硝酸甘油、普萘洛尔、维拉帕米治疗心绞痛的共同作用是
A. 减慢心率
B. 缩小心室容积
C. 扩张冠脉
D. 抑制心肌收缩力
E. 降低心肌耗氧量

正确答案：E。降低心肌耗氧量